手足无力、括约肌功能障碍、脚踩棉花感，最可能的颈椎病类型是
A. 椎动脉型颈椎病
B. 脊髓型颈椎病
C. 交感神经型颈椎病
D. 神经根型颈椎病
E. 复合型颈椎病

正确答案：B。脊髓型颈椎病

解析：手足无力、括约肌功能障碍、脚踩棉花感为脊髓型颈椎病（B对）的典型表现，此外还可出现触觉障碍、束胸感，双手精细动作笨拙，不能用筷子进食，肌力减退，四肢腱反射活跃或亢进，Hoffmann征、髌阵挛、踝阵挛及Babinski征等阳性。椎动脉型颈椎病（P727）（A错）主要表现为突发性眩晕而猝倒、偏头痛、听力减退或耳聋、视力障碍等。交感神经型颈椎病（P727）（C错）主要表现为交感神经受刺激的症状，可为兴奋性也可为抑制性。神经根型颈椎病（P726）（D错）主要表现为颈肩痛，并向上肢放射，皮肤可有麻木、过敏等感觉异常，同时可有上肢无力、手指动作不灵活，牵拉试验及压头试验阳性。复合型颈椎病（E错）少见，多有两种或多种类型症状同时出现。